男，35岁。间断血压增高伴心悸3个月。查体：正力体型，双上肢血压200/130mmHg，双肺呼吸音清，心率78次/分，律齐，腹软，腹部未闻及杂音。血压增高时测血游离间苄肾上腺素、去甲肾上腺素和尿儿茶酚胺显著增高。血钾和肌酐正常，尿常规正常。CT示双肾、肾上腺和肾动脉未见异常。该患者需首先考虑的疾病是
A. 皮质醇增多症
B. 肾动脉狭窄
C. 嗜铬细胞瘤
D. 肾上腺皮质功能减退症
E. 原发性醛固酮增多症

正确答案：C。嗜铬细胞瘤

解析：中年男性患者，间断头痛，面色苍白，出汗，心悸，发作性血压升高，血压200/130mmHg，平时血压正常（符合嗜铬细胞瘤阵发性高血压型表现），故诊断为嗜铬细胞瘤（C对）。皮质醇增多症（A错）主要是由于促肾上腺皮质激素(ACTH) 分泌过多导致肾上腺皮质增生或者肾上腺皮质腺瘤，引起糖皮质激素过多所致，80% 病人有高血压，同时有向心性肥胖、满月脸、水牛背、皮肤紫纹毛发增多、血糖增高等表现。肾动脉狭窄（B错）所致的高血压一经发现一般进展迅速或突然加重，平素血压亦为高血压。肾上腺皮质功能减退症（D错）最具特征性者为全身皮肤色素加深，暴露处、摩擦处、乳晕、瘢痕等处尤为明显，黏膜色素沉着见于牙限、舌部、颊黏膜等处，系垂体ACTH 、黑色素细胞刺激素分泌增多所致，心血管系统则表现为血压降低，心脏缩小，心音低钝；可有头晕、眼花、直立性晕厥。原发性醛固酮增多症（E错）患者中高血压为最常出现的症状，随着病情进展，血压逐渐升高，对常用降血压药效果不及一般原发性高血压，部分病人可呈难治性高血压，出现心血管病变、脑卒中。